下列关于釉质形成缺陷症中局限性凹陷者的叙述不正确的是
A. 凹陷呈横向排列
B. 缺陷周围为钙化不全
C. 较大面积的缺陷
D. 病变位于牙舌面中1/3
E. 切缘、咬合面常不累及

正确答案：D。病变位于牙舌面中1/3

解析：局限性凹陷者，表现为横向排列的凹陷、线形缺损，或较大面积的缺陷而周围为钙化不全。典型病变位于牙颊面中1/3，切缘、咬合面常不累及。病变影响乳、恒牙列，或仅影响乳牙列，所有牙或少数牙受累。常染色体隐性型（IC型）病变更严重，常累及两牙列的所有牙。掌握“釉质形成缺陷（釉质发育不全）”知识点。